生长缓慢的肿瘤与生长迅速的肿瘤，对于筛检试验可能会导致
A. 领先时间偏倚
B. 病程长短偏倚
C. 选择性偏倚
D. 错误分类偏倚
E. 信息偏倚

正确答案：B。病程长短偏倚

解析：本题考查病程长短偏倚。病程偏倚指疾病被检出的可能性和疾病的进展速度有关。生长缓慢的肿瘤与生长迅速的肿瘤，对于筛检试验可能会导致病程长短偏倚（B对ACDE错）。